蛋白质从细胞外液进入细胞内的转运方式是
A. 主动转运
B. 单纯扩散
C. 易化扩散
D. 入胞作用
E. 出胞作用

正确答案：D。入胞作用